关于寿命表，以下正确的陈述是
A. 现时寿命表资料来自对特定人群某时点的调查
B. 定群寿命表资料来自对特定人群某时点的调查
C. 期望寿命又称平均寿命，指所有调查对象死亡时年龄的平均值
D. 随访某特定人群的死亡情况所得资料可做现时寿命表分析
E. 因期望寿命受人群年龄构成的影响，不能直接比较不同地区的期望寿命

正确答案：A。现时寿命表资料来自对特定人群某时点的调查

解析：本题考查寿命表的内容。现时寿命表数据来源于横断面观察，以获得的某年所有年龄组死亡率为已知数据进行的调查（A对）。定群寿命表也称为“队列寿命表”，其数据由随访观察获得，反映了某一人群（事先确定的队列）的死亡经历。它反映的是历史情况，而不是当前的人群健康状况（BD错）。期望寿命是指同时出生的一代人或到某一岁数时，尚能生存的平均年数（C错）。期望寿命不受年龄构成的影响（E错）。